属于CYP450酶系最主要的代谢亚型酶，大约有50%以上的药物是其底物，该亚型酶是
A. CYP1A2
B. CYP3A4
C. CYP2A6
D. CYP2D6
E. CYP2E1

正确答案：B。CYP3A4

解析：本题考查CYP450酶系。属于CYP450酶系最主要的代谢亚型酶，大约有50%以上的药物是其底物，该亚型酶是CYP3A4（B对）。P450（CYP450）酶是一个多功能酶系，可以催化数十种代谢反应。CYP450存在于肝脏及肝脏外组织的内质网中，是一组酶的总称，由许多同工酶和亚型酶组成。目前已鉴别了17种以上的CYP亚型酶，其中CYP3A4是最主要的代谢酶，大约有150种药物是该酶的底物，约占全部被P450代谢药物的50%。细胞色素P450常见亚型：CYPlA2（A错）（占总P450代谢药物的4%）、CYP2A6（C错）（2%）、CYP2C9（10%）、CYP2C19（2%）、CYP2D6（D错）（30%）、CYP2E1（E错）（2%）、CYP3A4（50%）。